患者女，36岁。骤然剧烈腹痛6小时，经检查诊断为胃十二指肠溃疡急性穿孔合并腹膜炎，现上腹部拒按，伴恶心呕吐，大便干结，小便短少，舌苔薄白，脉弦细数，其证型是
A. 实热
B. 厥脱
C. 气血阻闭
D. 气血双虚
E. 肝气郁结

正确答案：C。气血阻闭

解析：患者上腹部拒按，伴恶心呕吐诊断为胃十二指肠溃疡急性穿孔合并腹膜炎，大便干结，小便短少，舌苔薄白，脉弦细数诊断为气血阻闭证（C对）。实热证证见壮热烦躁，面红目赤，渴喜冷饮，胸痛痰黄、腹痛拒按，大便秘结，小便短赤，舌红苔黄，脉洪数、滑实等（A错）。厥脱临床以面色苍白、四肢厥冷、大汗淋漓、表情淡漠或烦躁不安、脉细弱、血压急剧下降为主要特征（B错）。气血两虚表现为头晕目眩，少气懒言，乏力自汗，舌淡苔白，脉细弱（D错）。肝气郁结临床表现多见胁痛，胸闷，脘胀，嗳气，妇女月经不调等症（E错）。